在学校健康教育活动中，属于“项目质量控制审查”的评价类型是
A. 需求评价
B. 过程评价
C. 近期效应评价
D. 远期效应评价
E. 结局评价

正确答案：B。过程评价